男，24岁。鞍区肿瘤切除手术后第1天，尿量＞4000ml/24h，尿比重＜1.005，并逐渐出现意识障碍。复查头颅CT为常见术后改变，最可能的原因是
A. 颅内血肿
B. 蛛网膜下腔出血
C. 下丘脑损伤
D. 脑水肿
E. 脑干损伤

正确答案：C。下丘脑损伤

解析：青年男性患者，鞍区肿瘤切除术后，尿量＞4000ml/24h（正常成人尿量为1000～2000ml/24h，4000～10000ml/24h提示为尿崩症），尿比重＜1.005（正常成人尿比重为1.015～1.025，尿比重降低为尿崩症的表现），并逐渐出现意识障碍，复查头颅CT为常见术后改变（可排除术后颅内出血等并发症），结合患者病史、临床表现和相关检查，应诊断为尿崩症。尿崩症是颅脑损伤、颅脑肿瘤术后的常见并发症，为下丘脑损伤（C对）所致，导致ADH分泌减少，肾脏浓缩功能降低，排出大量低比密尿液。颅内血肿（A错）常见于头部外伤的病人，以颅内压增高和不同程度的意识障碍为主要表现，CT扫描可见双凸透镜形、新月形、类圆形或不规则的高密度影；蛛网膜下腔出血（B错）常见于颅内动脉瘤和脑血管畸形，以偏瘫、视力视野障碍为主要表现，CT表现为脑沟与脑池内高密度影；脑水肿（D错）多见于脑损伤、脑肿瘤、脑缺血等病变的初期，上述三种疾病均不会出现尿崩症。脑干损伤（E错）较少见，多由外伤引起，表现为伤后立即昏迷并进行性加重，瞳孔大小多变，早期发生呼吸、循环功能衰竭，可出现去皮质强直及双侧病理征阳性等表现。